细胞呈星形，有胞质突起相互连接的是
A. 成纤维细胞
B. 成牙本质细胞
C. 树突状细胞
D. T淋巴细胞
E. 巨噬细胞和未分化的间充质细胞

正确答案：A。成纤维细胞

解析：成纤维细胞：是牙髓中的主要细胞，故又称为牙髓细胞。细胞呈星形，有胞质突起相互连接，核染色深，胞质淡染、均匀。掌握“牙髓”知识点。